骨会是
A. 大杼
B. 绝骨
C. 太渊
D. 膈俞
E. 膻中

正确答案：A。大杼

解析：该题考查八会穴，属基础记忆内容。骨会大杼（A对）。髓会绝骨（B错）。脉会太渊（C错）。血会膈俞（D错）。气会膻中（E错）。记忆：脏会章门，腑中脘，气会膻中，血膈俞，筋阳陵泉，脉会太渊，骨大杼，髓绝骨。